调查时由于调查对象的代表性很差，使结果出现误差的偏倚是
A. 选择性偏倚
B. 无应答偏倚
C. 测量偏倚
D. 回忆偏倚
E. 检查者偏倚

正确答案：A。选择性偏倚

解析：本题考查口腔健康状况调查的样本含量及误差。偏倚一般分三类，即选择性偏倚、无应答偏倚和信息偏倚。此题由于调查时样本人群选择错误，使调查对象的代表性差，这样造成的偏倚为选择性偏倚（A对）。